痛风患者起居调护中不应
A. 保暖
B. 过劳
C. 防潮
D. 户外大量活动
E. 充足睡眠

正确答案：B。过劳

解析：过劳不但不利于患者痛风改善，还可能诱发痛风关节炎等病症（B对）；痛风患者平时应注意保暖，寒冷可能会引发痛风发作（A错）；潮湿的环境会加重痛风症状（C错）；痛风患者，尤其是伴有肥胖者，要控制和减轻体重，因此适合适当运动（D错）；对于痛风患者来讲，持续熬夜会使抵抗力下降，各器官功能代谢变慢，尿酸堆积无法排出体外，会提高痛风发作风险（E错）。